患者，男，58岁。高血压病史20年，近1年常觉心慌，气短，昨夜睡眠中突然憋醒，胸闷，咳嗽，气喘，急诊入院经检查诊断为左心衰竭。治疗宜用
A. 肾上腺素
B. 异丙肾上腺素
C. 东莨菪碱
D. 吗啡
E. 去甲肾上腺素

正确答案：D。吗啡

解析：心源性哮喘是因急性左心衰竭患者突发肺水肿，导致肺泡换气功能障碍，二氧化碳潴留刺激呼吸中枢，引起浅而快的气促、窒息感和呼吸困难。临床常采用综合性治疗（包括强心、利尿和扩张血管等）措施。静脉注射吗啡也是主要的治疗的方法。其机制为：①吗啡具有镇静作用，可消除病人的紧张和恐惧情绪。②抑制呼吸中枢对CO₂敏感性，使呼吸由浅快变得深慢。③同时还能打张外周血管，降低外周阻力，减轻心脏前、后负荷。有利于肺水肿的消除（D对）。